指出下列关于发育的百分位数法描述中，哪项是错误的
A. 在大数量调查基础上计算各指标的百分位数
B. 可用百分位数划分发育等级
C. 可制成某指标的百分位数图
D. 在百分位数图上能观察出儿童发育的变动
E. 能看出身体发育的匀称程度

正确答案：E。能看出身体发育的匀称程度